单个牙齿的牙周膜中的血管分布最密集的区域是
A. 近牙颈部
B. 近根尖部
C. 近牙龈1/3处
D. 近牙龈2/3处
E. 近根尖1/3处

正确答案：C。近牙龈1/3处

解析：在单个牙齿的牙周膜中近牙龈1/3处的血管分布最密集。掌握“牙周膜”知识点。